表示弱酸（或弱碱）性药物非解离型和解离型的比例与环境关系pH的公式是
A. Noyes-Whitney公式
B. Poiseuile公式
C. Henderson-Hasselbalch方程
D. Ostwald Freundlich方程
E. Arrhenius公式

正确答案：C。Henderson-Hasselbalch方程

解析：本题考查pH分配假说。pH分配假说指药物在体内的吸收与药物在胃肠道的解离程度与油水分配系数有关，具体关系可用Henderson-Hasselbalch方程（C对）表示。此方程旨在以酸解离常数pKa来描述pH的变化。